治疗哮病寒包热哮证，应首选
A. 射干麻黄汤
B. 三子养亲汤
C. 定喘汤
D. 厚朴麻黄汤
E. 麻杏石甘汤

正确答案：D。厚朴麻黄汤

解析：射干麻黄汤功能温肺化饮，止哮平喘，为哮病冷哮证的选方（A错）。三子养亲汤功能涤痰利窍，降气平喘，为哮病风痰哮的选方（B错）。定喘汤功能清热宣肺，化痰平喘，为哮病热哮证的选方（C错）。哮病寒包热哮为痰热壅肺，复感风寒，客寒包火，肺失宣降所致，治宜解表散寒，清化热痰，方选小青龙石膏汤或厚朴麻黄汤（D对）。麻杏石甘汤功能宣肺泄热，降气平喘，为喘证表寒肺热证的选方（E错）。